哪一项不是下颌骨易发生骨折的薄弱部位
A. 正中联合
B. 颏孔区
C. 下颌角
D. 喙突
E. 髁状突颈部

正确答案：D。喙突

解析：本题考查下颌骨易发生骨折的薄弱部位。喙突（D错，为本题的正确答案）位于颧弓内侧，受颧弓保护，一般不会发生骨折。下颌骨发生骨折的部位常与解剖结构有关，有些部位在结构和力学上属于薄弱部位，如正中联合（A对）、颏孔区 （B对）、下颌角（C对）及髁状突颈部（E对）。